男，45岁。车祸致左枕部着地，当即意识丧失，送至附近医院途中右侧肢体间断性抽搐伴喷射性呕吐3次。查体：P56次/分，BP160/95mmHg，浅昏迷、躁动，右侧瞳孔直径约4mm，左侧2mm；对光反射：左侧存在，右侧消失，左侧肌力3级，右侧肌力5级；左枕部头皮水肿，颈强直。颅内出血的来源是
A. 板障静脉
B. 脑表面小血管
C. 下矢状窦
D. 横窦
E. 硬脑膜中动脉

正确答案：B。脑表面小血管

解析：中年男性患者，车祸致左枕部着地，当即意识丧失，送至附近医院途中右侧肢体间断性抽搐伴喷射性呕吐3次（颅内压增高）。查体：P56次/分（正常值60～100次/分），BP160/95mmHg（正常值90～120/60～80mmHg），浅昏迷、躁动，右侧瞳孔直径约4mm（正常值2～4mm），左侧2mm；对光反射：左侧存在，右侧消失，左侧肌力3级，右侧肌力5级；左枕部头皮水肿，颈强直。综合患者的症状、体征和辅助检查，初步诊断为右额急性硬脑膜下血肿伴右小脑幕切迹疝。颅内出血的来源是脑表面小血管（B对）。板障静脉（A错）多是板障静脉瘤的来源。下矢状窦（C错）多是脑静脉窦血栓形成的来源。横窦（D错）不是硬脑膜下血肿所致出血的来源。硬脑膜中动脉（E错）多是硬脑膜外血肿出血的来源。